患者，女，26岁。因心悸、手颤、易饥饿、烦躁易怒前来就诊，实验室检查游离甲状腺素（FT₃，FT₄）增高、促甲状腺素（TSH）降低，诊断为甲状腺功能亢进症。医师处方给予抗甲状腺药治疗。目前患者心动过速（115次/min），应考虑联合应用的药物是
A. 特布他林
B. 碘化钾
C. 普萘洛尔
D. 利多卡因
E. 左甲状腺素

正确答案：C。普萘洛尔

解析：本题考查普萘洛尔。应考虑联合应用的药物是普萘洛尔（C对）。普萘洛尔用于控制甲状腺功能亢进症的心率过快，也可用于治疗甲状腺危象。特布他林（A错）为选择性的β₂受体激动剂，临床用于治疗支气管哮喘，喘息性支气管炎，肺气肿等。碘化钾（B错）用于地方性甲状腺肿的预防与治疗，甲状腺功能亢进症手术前准备及甲状腺亢进危象。利多卡因（D错）属于Ⅰb类抗心律失常药，对短动作电位的心房肌无效，因此仅用于室性心律失常。左甲状腺素（E错）主要用于治疗甲减、单纯性甲状腺肿及甲状腺癌手术后甲减的辅助治疗，亦可用于诊断甲状腺功能亢进的抑制试验。